某男性患者近日来少尿，恶心呕吐，血清内生肌酐清除率测定为10mL/min，诊断应考虑为
A. 终末期肾功能衰竭代偿期
B. 肾功能正常
C. 早期肾功能衰竭
D. 晚期肾功能衰竭
E. 肾功能不全氮质血症期

正确答案：D。晚期肾功能衰竭

解析：单位时间内，肾脏能将多少毫升血浆中的内生肌酐全部清除出去，称为内生肌酐清除率。Ccr10～25mL/min为肾功能衰竭期（C错）；Ccr<10mL/min为肾功能衰竭终末期（D对B错）。在肾功能代偿期阶段，内生肌酐的清除率能达到一半以上，肾小球滤过率一分钟至少减少30～60mL（A错）。氮质血症期患者肾脏的浓缩功能出现障碍，会出现多尿或者频繁起夜，一部分人群会伴随着不同程度的贫血，并且也会伴随着血肌酐以及尿素氮的增高。在此阶段患者会出现全身无力、食欲明显减退，全身有明显的不适感以及恶心呕吐（E错）。